8岁左右，随着颌骨生长后牙间隙增大，以下哪种牙齿的邻面龋开始增多
A. 乳切牙
B. 乳侧切牙
C. 乳尖牙
D. 乳磨牙
E. 第一恒磨牙

正确答案：D。乳磨牙

解析：8岁左右，乳磨牙的邻面龋开始增多，与颌骨生长后牙间隙增大有关。掌握“龋病的临床表现与分类”知识点。